《中国药典》规定葡萄糖注射液的pH值为3.2～6.5，在测定供试品溶液pH值之前，对酸度计进行校正（定位）时，应使用的标准缓冲液是
A. 苯二甲酸盐标准缓冲液（pH4.01）
B. 磷酸盐标准缓冲液（pH6.86）
C. 草酸盐标准缓冲液（pH1.68）与苯二甲酸盐标准缓冲液（pH4.01）
D. 苯二甲酸盐标准缓冲液（pH4.01）与磷酸盐标准缓冲液（pH6.86）
E. 草酸盐标准缓冲液（pH1.68）与磷酸盐标准缓冲液（pH6.86）

正确答案：E。草酸盐标准缓冲液（pH1.68）与磷酸盐标准缓冲液（pH6.86）

解析：本题考查标准缓冲液的选择。测定前选择两种标准缓冲液，并使供试液的pH值处于两者之间。葡萄糖注射液的pH值应为3.2～6.5，为使供试液的pH值处于两者之间，选择草酸盐标准缓冲液（pH1.68）与磷酸盐准缓冲液（pH6.86）（E对）。